左侧输尿管在正常行程中通过
A. 左精索内动脉之前方
B. 从子宫动脉前下方
C. 腰骶干后方
D. 以上全错
E. 以上全对

正确答案：D。以上全错

解析：精索（A错）是输精管通过的地方。女性输尿管进入膀胱前从子宫动脉后下方绕过（B错）。输尿管盆部经过腰骶干前方下行（C错，故D为本题正确答案）。